临床试验设计基本原则不包括
A. 随机
B. 对照
C. 盲法
D. 自愿
E. 以上均对

正确答案：D。自愿

解析：本题考查临床试验设计的基本原则。临床试验设计基本原则不包括自愿（D错，为本题的正确答案）。临床试验与其他流行病学方法相比有其特点。首先，临床试验的设计应符合三个基本原则，即随机（A对）、对照（B对）和盲法（C对）。其次，临床试验的研究对象是人，不管研究的内容是诊断技术，还是治疗方法或预防措施，所有的试验必须在人体上进行，因此需要试验对象自愿参与并有良好的依从性。再次，临床试验是一种特殊的前瞻性研究，它被人为地给予了干预，包括分组以及干预措施。最后，临床试验需要有一定的时间周期，因为它需要经历疾病发生的完整周期，观察不同疾病需要不同的周期。